不易导致便秘或腹泻不良反应的抗酸药是
A. 氢氧化铝
B. 三硅酸镁
C. 碳酸钙
D. 铝碳酸镁
E. 硫糖铝

正确答案：D。铝碳酸镁

解析：本题考查铝碳酸镁。不易导致便秘或腹泻不良反应的抗酸药是铝碳酸镁（D对）。铝碳酸镁在胃中可迅速转化为氢氧化铝和氢氧化镁。铝离子可松弛胃平滑肌引起胃排空延迟和便秘，而镁有导泻作用，因此服用铝碳酸镁对胃排空和小肠功能影响很小，基本上抵消了便秘和腹泻等不良反应。氢氧化铝（A错）可能引起便秘。三硅酸镁（B错）为抗酸药，镁离子在胃肠道不易被吸收，大剂量使用，由于渗透作用，引起轻度腹泻。碳酸钙（C错）、硫糖铝（E错）长期大剂量服用引起严重便秘，甚至形成粪结块引起肠梗阻。